负责基本药品评估性抽验工作的是
A. 国家食品药品监督管理局
B. 中国食品药品检定研究所
C. 省级药品监督管理部门
D. 省级工商行政管理部门
E. 省级卫生行政部门

正确答案：A。国家食品药品监督管理局

解析：本题考查药品监督管理。国家食品药品监督管理部门（A对）负责基本药物的评估性抽验工作。